治疗心动悸阴虚火旺证应首选
A. 归脾汤
B. —贯煎合酸枣仁汤
C. 桂枝甘草龙骨牡蛎汤
D. 五味子汤
E. 天王补心丹

正确答案：E。天王补心丹

解析：心动悸（即为西医的快速性心律失常），阴虚火旺证的机理为肾阴不足，水不济火不能上济于心，以致心火内动，扰动心神，故见心悸不宁，心烦少寐；阳亢于上则还可见头晕目眩；阴亏于下则还可见耳鸣腰酸，故治法为滋阴降火，养心安神，代表方剂为滋阴养心安神的天王补心丹加减（E对）。归脾汤（A错）功效为补血养心，益气安神，多用于治疗心脾气血不足证；一贯煎合酸枣仁汤（B错）多用于治疗阴血亏虚，神志不安证；桂枝甘草龙骨牡蛎汤（C错）功效为温补心阳，安神定悸，多用来治疗心阳不振证；五味子汤（D错）功效为养阴生津，多用以治疗心阳不振兼伤阴者。